丁香主治的病证是
A. 蛔虫腹痛
B. 脚气肿痛
C. 阳虚外感
D. 胃寒呃逆
E. 寒湿痹痛

正确答案：D。胃寒呃逆

解析：丁香功能温中降逆，散寒止痛，温肾助阳。能用于治疗胃寒呕吐、呃逆，脘腹冷痛，阳痿，宫冷等病证（D对）。